“热者寒之”适用于治疗
A. 阴偏盛
B. 阳偏胜
C. 阴偏衰
D. 阳偏衰
E. 阴阳两虚

正确答案：B。阳偏胜

解析：阳盛的病机特点为阳盛而阴未虚，临床表现以实热证为主，可见身热，面赤，烦躁，舌红苔黄，脉数等症状；若阳盛伤及阴液，则兼有口渴、小便短少等表现。“热者寒之”指热证要用寒凉的方药治疗，属逆病性而用治的正治法。根据表、里、虚、实之不同，表热证用辛凉解表，疏散风热；里热证，实者用清法通里攻下，虚者则用甘凉养阴透热或滋阴清热等法（B对）。